治疗慢性肾衰竭湿热蕴结证，应首选
A. 黄连解毒汤
B. 清瘟败毒饮
C. 黄连温胆汤
D. 生脉饮合参附汤
E. 参芪地黄汤

正确答案：C。黄连温胆汤

解析：慢性肾衰竭湿热蕴结证，机理为湿热久羁，下注下焦，或中焦湿郁化热，脾胃失于升清降浊，故治疗中焦湿热宜清化和中，下焦湿热宜清利湿热，代表方药中焦湿热者以清化和中的黄连温胆汤（C对）加减，下焦湿热以清利湿热的四妙丸加减。黄连解毒汤（A错）可以泻火解毒，治疗急性肾衰竭热毒炽盛证；清瘟败毒饮（B错）可以清热解毒，活血化瘀，治疗急性肾衰竭火毒瘀滞证；生脉饮合参附汤（D错）可以益气养阴，回阳固脱，治疗急性肾衰竭气脱津伤证；参芪地黄汤（E错）可益气养阴，治疗急性肾衰竭气阴两伤证。